某男性，冶炼厂选煤工，年龄45岁，工龄10年以上。近来主诉咳嗽、气短。X线胸片呈肺纹理增加。此工人最可能患何种尘肺
A. 矽肺
B. 尘肺
C. 石棉肺
D. 煤肺
E. 硅酸盐肺

正确答案：D。煤肺

解析：本题考查煤肺的概念。煤肺（D对ABCE错）是采煤工作面的工人常患的疾病，主要因为接触单纯性煤尘（煤尘中游离SiO₂含量在5%以下）导致的尘肺。本题中工人为冶炼厂选煤工，其职业史、接触史、工龄、症状均符合煤肺的诊断标准，因此将其诊断为煤肺。